女性，36岁。突然寒战高热，腰痛并尿急、尿痛1周，既往无类似病史，检查：体温39度，右侧肾区叩击痛阳性，尿蛋白（+），白细胞20~30个/HP，白细胞管型0~2个/低倍，比重1.022。为了确定诊断还需要做的最主要的检查是
A. 血β₂微球蛋白
B. 尿β₂微球蛋白
C. 血BUN
D. 尿细菌培养
E. 血肌酐

正确答案：D。尿细菌培养

解析：患者初步考虑为急性肾盂肾炎，是由于各种病原微生物在肾盂肾盏中生长、繁殖而引起的炎症性疾病。尿路感染的诊断分为两步：一是尿路感染的诊断；二是尿路感染的定位诊断。因此，患者目前的需要进行的是尿路感染的诊断。尿细菌培养是尿路感染的金标准，所以为了诊断还需做的最主要的检查是尿细菌培养（D对）。血β₂微球蛋白（A错）可反映肾小球的滤过功能及滤过负荷，常用于肾移植后的检测。尿β2微球蛋白（B错）可反映肾小管功能及滤过负荷，有助于鉴别上、下尿路感染，增多提示上尿路感染，但目前患者需明确的是否存在尿路感染，而定位诊断是下一步的诊断过程。血BUN（C错）、血肌酐（E错）是监测肾功能的主要指标，对尿路感染的诊断无帮助。